肺结核病的化疗原则是
A. 早期联合适量规律半程
B. 早期联合适量规律全程
C. 早期联合足量规律全程
D. 早期分别适量规律全程
E. 联合适量规律全程

正确答案：B。早期联合适量规律全程

解析：化学治疗的主要作用是杀灭细菌、防止耐药菌产生，所以必须遵循早期联合适量规律全程的化疗原则（B对）。